含两个羧基的非前药ACE抑制剂是
A. 赖诺普利
B. 福辛普利
C. 马来酸依那普利
D. 卡托普利
E. 雷米普利

正确答案：A。赖诺普利

解析：本题考查赖诺普利。含有两个羧基的非前药ACE抑制剂是赖诺普利（A对）。福辛普利（B错）是福辛普利拉的前体药物；马来酸依那普利（C错）是依那普利拉的前体药物；卡托普利（D错）不是前体药物，但只含一个羧基；雷米普利（E错）是雷米普利拉的前体药物。